既治咽喉肿痛，又治毒蛇咬伤的药是
A. 射干
B. 秦皮
C. 山豆根
D. 白花蛇舌草
E. 马齿苋

正确答案：D。白花蛇舌草

解析：本题考查的是白花蛇舌草的主治病证。既治咽喉肿痛，又治毒蛇咬伤的药是白花蛇舌草（D对）。白花蛇舌草【主治病证】（1）痈肿疮毒，咽喉肿痛，肠痈，毒蛇咬伤。（2）热淋涩痛，小便不利。（3）胃癌，食管癌，直肠癌。射干（A错）【主治病证】（1）咽喉肿痛（证属热结痰瘀者尤宜）。（2）痰多咳喘。（3）久疟疟母，闭经，痈肿，瘰疬、癥瘕。秦皮（B错）【主治病证】（1）湿热泻痢。（2）赤白带下。（3）目赤肿痛，目生翳膜。山豆根（C错）【主治病证】（1）火毒蕴结之咽喉肿痛，肺热咳嗽。（2）牙龈肿痛，痈肿疮毒，湿热黄疸。马齿苋（E错）【主治病证】（1）热毒血痢，热毒疮疡。（2）血热崩漏、便血。（3）热淋，血淋。